对β₂受体有选择性激动作用的平喘药是
A. 茶碱
B. 肾上腺素
C. 沙丁胺醇
D. 色甘酸钠
E. 异丙肾上腺素

正确答案：C。沙丁胺醇

解析：平喘药包括抗炎平喘药、支气管扩张药（β受体激动药、茶碱类、抗胆碱药）、抗过敏平喘药（炎症细胞膜稳定剂、H1受体阻断剂）。对β₂受体有选择性激动作用的平喘药是沙丁胺醇（C对），其可选择性激动气道β₂受体，使气道平滑肌松弛，缓解或消除支气管痉挛和气道狭窄。茶碱（A错）属于茶碱类，是磷酸二酯酶抑制剂，使细胞内cAMP水平升高而舒张支气管。肾上腺素和异丙肾上腺素是非选择性β受体激动剂（BE错），可激动β₁受体和β₂受体。色甘酸钠（D错）是炎症细胞膜稳定剂，通过稳定肥大细胞、抑制气道感觉神经末梢功能与气道神经源性炎症、阻断炎症细胞介导的反应，是抗过敏平喘药。